确定垂直距离的方法中，最可靠的方法是
A. 面部距离均等测定法
B. 面部外形观察法
C. 息止颌位测定法
D. 拔牙前记录
E. 以旧义齿参考

正确答案：D。拔牙前记录

解析：①息止颌位法：利用息止颌位的垂直距离减去息止（牙合）间隙的方法。测量息止颌位时鼻底至颏底的距离减去2～3mm，作为咬合垂直距离，上下颌（牙合）托在口内咬合时应达到此垂直距离。②面部垂直距离等分法：面部中线上发迹、眉尖点、鼻底、颏底四点将面部分为高度相等的三部分，此为面部比例三等分法。眼外眦（外眼角）至口裂的垂直距离与鼻底至颏底的距离相等，此为面部比例三等分法。每个人的面部比例不是绝对的，因此，此方法只作为确定垂直距离的参考。③面部外形观察法：天然牙列存在并且咬在正中（牙合）位时，上下唇呈自然接触闭合，口裂约呈平直状，口角不下垂，鼻唇沟和颏唇沟的深度合宜，面部下1/3与面部的比例是协调的，这种面部外形资料可用作确定垂直距离的参考。此外，如果患者有拔牙前咬合位垂直距离的记录，则可作为无牙颌修复时确定垂直距离的较好的参考。因为有天然牙存在的情况最能够反应患者息止颌间隙，所以最可靠的方法应为拔牙前记录。掌握“全口义齿颌位关系及上（牙合）架”知识点。